以下关于双端固定桥固位体的说法中错误的是
A. 要有共同就位道
B. 两端固位体的固位力应基本相等
C. 固位体固位力应与牙合力大小相适应
D. 共同就位道应与牙长轴平行
E. 固位体固位力应与桥体跨度相适应

正确答案：D。共同就位道应与牙长轴平行

解析：本题考查双端固定桥固位体。关于双端固定桥固位体的说法中错误的是共同就位道应与牙长轴平行（D错，为本题的正确答案）。双端固定桥又称完全固定桥，两端都有固位体，且固位体与桥体之间为固定连接，因固定桥的各固位体与桥体连接成为一个整体，固定桥在桥基牙上就位时只能循一个方向戴入，所以各桥基牙间必须要有共同就位道（A对），否则难以就位。在一般情况下，只要牙排列位置正常，（牙合）力方向与牙长轴方向基本一致，顺着各桥基牙的长轴方向做牙体预备，即可获得共同就位道。但对于倾斜移位的牙来说，（牙合）力的方向与牙长轴方向不一致，若采用与牙长轴平行的共同就位道方向，不仅需要磨除较多的牙体组织，容易造成牙髓损伤，且（牙合）力不易沿着牙长轴传导，牙周组织也容易受到创伤，因此倾斜基牙的共同就位道不一定与牙长轴平行，此时应根据基牙的形态、位置、排列以及固位体的设计，以少磨除牙体组织为原则来寻求共同就位道。对于双端固定桥来说，若两端固位力相差悬殊，则固位力弱的一端固位体易松动。当一端固位体松动，而固位力强的另一端固位体依然稳固时，患者不易察觉，其后果往往是松动端桥基牙产生继发龋，甚至损及牙髓，而稳固端基牙的牙周组织往往也受到损害，因此，固定桥两端固位体的固位力应基本相等（B对）。固位体固位力大小设计应与（牙合）力大小（C对）、桥体跨度（E对）及桥体的弧度相适应，桥体跨度越长、弧度越大、（牙合）力越大者，要求固位体的固位力越大，必要时可增加基牙以增加固位力。